初孕妇，24岁。妊娠38周，血压170/110mmHg，尿蛋白（+++），突然抽搐，后昏迷。首选的治疗方法是
A. 静脉推注硫酸镁
B. 引产
C. 积极控制抽搐，病情控制2小时内终止妊娠
D. 积极治疗，24小时内行剖宫产
E. 控制抽搐，稳定病情，至自然分娩

正确答案：C。积极控制抽搐，病情控制2小时内终止妊娠

解析：该初孕妇，妊娠38周，血压170/110mmHg（重度子痫前期收缩压≥160mmHg和（或）舒张压≥110mmH），尿蛋白（+++）（重度子痫前期随机尿蛋白≥（+++）），出现抽搐症状，并昏迷（子痫是在子痫前期基础上发生不能用其它原因解释的抽搐，昏迷），应诊断为子痫，首选的治疗方法是积极控制抽搐，病情控制2小时内终止妊娠（C对ABDE错）。